上颌牙列的纵（牙合）曲线是一条
A. 凸向上的曲线
B. 凸向下的曲线
C. 凹向上的曲线
D. 凹向下的曲线
E. 与（牙合）平面平行

正确答案：B。凸向下的曲线

解析：上颌牙列的纵（牙合）曲线：它的曲度与Spee曲线略有不同。连接上颌切牙的切缘，尖牙的牙尖、前磨牙及磨牙的颊尖，呈一条凸向下的曲线，称纵（牙合）曲线。掌握“牙列”知识点。